下丘脑-垂体-性激素提前发动，功能亢进者为
A. 同性性早熟
B. 异性性早熟
C. 真性性早熟
D. 假性性早熟
E. 特发性性早熟

正确答案：C。真性性早熟

解析：青春期的生理发育和性器官成熟是受下丘脑-垂体-性腺轴（HPGA）的调控，由于儿童HPGA轴功能提前启动所致的性早熟称为真性性早熟（C对）。假性性早熟又称外周性性早熟，非受控于HPGA轴，有第二性征的发育和性激素水平的升高，但是患儿的HPGA轴并未启动，反而受到体内存在的性激素的负反馈抑制，无性腺的发育，在临床上，性征与真实性别一致的称为同性性早熟，不一致者称为异性性早熟（ABD错）。真性性早熟中原因不明者，称为特发性性早熟，又称为体质性性早熟，多见于女性（E错）。